在卫生资源分配上，形式公正是根据每个人
A. 都享有公平分配的权利
B. 实际的需要
C. 能力的大小
D. 社会贡献的多少
E. 在家庭中的角色地位

正确答案：A。都享有公平分配的权利

解析：在卫生资源分配上，遵循分配公正的原则，即在所有社会成员之间公平、公正地分配资源、受益和负担。包括形式公正和实质公正两个方面。形式公正即一视同仁，是一种形式上的平等。例如当甲流疫苗生产出来后，所有社会成员均应有机会接种。疫苗的生产者、分配者、销售者不应因有直接接触机会获得优先接种的权力。因此，形式公正是根据每个人都享有公平分配的权利（A对），实质公正则规定了可用来作为分配资源、受益和负担所依据的标准。实际上，卫生资源具体怎样分配，与实际的需要（B错）、能力的大小（C错）、社会贡献的多少（D错）和在家庭中的角色地位（E错）等复杂因素有关。